大细胞贫血治疗中，红细胞增生旺盛是加用
A. 维生素B₁₂
B. 叶酸
C. 维生素C
D. 铁剂
E. 维生素B₆

正确答案：D。铁剂

解析：本题考查大细胞贫血的治疗。大细胞贫血治疗中，红细胞增生旺盛是加用铁剂（D对ABCE错），加用铁剂是因为血红蛋白也就是血色素，是诊断贫血的主要指标，而血红蛋白作为红细胞的主要成分，主要由铁离子和珠蛋白组成。人体内蛋白质的储量丰富，但铁含量有限，所以贫血的原因大都出现在铁离子上。